白蛋白是人体血浆中最主要的蛋白质，浓度达
A. 38～48g/L
B. 40～55g/L
C. 50～55g/L
D. 58～68g/L
E. 70～75g/L

正确答案：A。38～48g/L

解析：白蛋白是人体血浆中最主要的蛋白质，浓度达38～48g/L。掌握“血液成分及血浆蛋白”知识点。